以下是青少年学习障碍的主要表现，除了
A. 阅读障碍
B. 计算障碍
C. 书写障碍
D. 非特定性学习障碍
E. 视听觉障碍

正确答案：E。视听觉障碍